冲脉为
A. 气海
B. 血海
C. 髓海
D. 阳脉之海
E. 阴脉之海

正确答案：B。血海

解析：本题考查的是冲脉的基本功能。冲脉为血海（B对）。冲脉的基本功能：（1）调节十二经气血，故称“十二经脉之海”。（2）冲为血海，有促进生殖之功能，并同妇女的月经有着密切的联系。气海（A错）指宗气在胸中的集聚之处。宗气：是积于胸中之气。宗气在胸中集聚之处，称作“气海”，又称“膻中”。髓海（C错）指脑。中医认为，脑为髓聚之处，故称“脑为髓之海”。阳脉之海（D错）指督脉。督脉的基本功能：（1）调节阳经气血，故称“阳脉之海”。（2）与脑、髓和肾的功能有关。阴脉之海（E错）指任脉。任脉的基本功能：（1）调节阴经气血，故称“阴脉之海”。（2）主持妊养胞胎。